四个处理组均数比较时，直接采用两组比较的t检验
A. 会增加犯Ⅰ型错误的概率
B. 会增加犯Ⅱ型错误的概率
C. 会出现检验效能不够的情况
D. 由于方差分析的两两比较方法不完善，故t检验更优
E. 不能确定犯Ⅰ型错误和Ⅱ型错误的概率是否会增加

正确答案：A。会增加犯Ⅰ型错误的概率